患者，男，36岁。背部左侧肿物约3年，大小约3cm×3cm×3cm，经常出现红、肿、热、痛等症状。检查后确诊为脂瘤。其简便有效的治疗方法是
A. 中药外敷
B. 中药内服
C. 神灯照法
D. 针刺治疗
E. 手术摘除

正确答案：E。手术摘除

解析：该患者确诊为脂瘤，治疗：中药外敷可用金黄膏等外敷脂瘤，但不是最简单有效的治法（A错）。脂瘤一般不需内治（B错）。神灯照功能活血消肿，解毒止痛，适用于痈疽轻证（C错）。针刺法常用于治疗瘰疬，瘾疹，蛇串疮等（D错）。手术摘除为治疗脂瘤最简单、最有效的方法（E对）。